背侧丘脑腹后外侧核接受纤维的传入
A. 脊髓丘系
B. 三叉丘系
C. 外侧丘系
D. 味觉
E. 嗅觉

正确答案：A。脊髓丘系

解析：腹后外侧核接受内侧丘系和脊髓丘系（A对）的纤维，腹后核发出纤维（丘脑中央辐射）经内囊投射至大脑皮质中央后回的躯体感觉中枢。